谢某，女性，34岁，发热2天后，感上颌左侧牙龈刺痒，灼痛，不久发现左侧上颌牙龈红肿，表面出现成簇的小米粒大小的透明水疱，破溃后成小溃疡。下列治疗措施中的哪项是最主要的
A. 保持口腔清洁
B. 肌内注射青霉素
C. 口服解热镇痛药
D. 口服无环鸟苷或板蓝根冲剂
E. 卧床休息补充多种维生素

正确答案：D。口服无环鸟苷或板蓝根冲剂

解析：本题考查单纯疱疹的疾病管理。谢某，女性，34岁，发热2天后，感上颌左侧牙龈刺痒，灼痛，不久发现左侧上颌牙龈红肿，表面出现成簇的小米粒大小的透明水疱，破溃后成小溃疡。下列治疗措施中最主要的是口服无环鸟苷或板蓝根冲剂（D对）。患者感上颌左侧牙龈刺痒，灼痛，后于左上颌牙龈处出现成簇的小米粒大小的透明水疱，破溃后成小溃疡，可判定患者所患疾病为疱疹性口炎，它是由单纯疱疹病毒引起的，对于疱疹性口炎来说最重要的是尽早应用抗病毒药物，无环鸟苷（阿昔洛韦）可治疗单纯疱疹感染，板蓝根冲剂可起到清热解毒的作用，因而口服无环鸟苷或板蓝根冲剂可对疱疹性口炎的控制有显著疗效。保持口腔清洁（A错）要贯穿病变过程始终，不属于主要的治疗措施。肌内注射青霉素（B错）对减轻炎症有一定疗效，需配合抗病毒药物才能明显减轻疾病严重程度。口服解热镇痛药（C错）、卧床休息补充多种维生素（E错）都是属于治疗措施，但仅作为辅助治疗，治标不治本，由病毒感染引起的疾病，只有先采取抗病毒治疗措施才能有效控制病变发展。